在HEV内皮细胞表面的是
A. CD34
B. L-selectin
C. CD19
D. CD56
E. ICOS

正确答案：A。CD34